龋损的釉质形成潜行性破坏，并且临床上能够看见牙齿表面的蓝白色外观，证明龋损达到
A. 釉质表面
B. 釉质牙本质界
C. 牙骨质
D. 釉质牙骨质界
E. 牙本质牙骨质界

正确答案：B。釉质牙本质界

解析：当龋损达到釉牙本质界，即向侧方扩展，形成潜行性破坏，以此种方式釉质可出现广泛损害，导致临床上所见牙表面的蓝白色外观。掌握“牙釉质龋”知识点。